下列属于条件反射的是
A. 咀嚼、吞咽食物引起胃液分泌
B. 异物接触眼球引起眼睑闭合
C. 叩击股四头肌腱引起小腿前伸
D. 强光刺激视网膜引起瞳孔缩小
E. 闻到食物香味引起唾液分泌

正确答案：E。闻到食物香味引起唾液分泌

解析：反射是神经活动的基本方式，人和高等动物的反射分为非条件反射和条件反射两类：非条件反射指生来就有、数量有限、比较固定和形式低级的反射活动，是人和动物在长期的种系发展中形成的，它使人和动物能够初步适应环境，对于个体生存和种系生存具有重要意义；条件反射是指通过后天学习和训练而形成的反射，它是反射活动的高级形式，是在非条件反射的基础上不断建立起来的，其数量是无限，可以建立，也能消退。闻到食物香味引起唾液分泌（E对）后天学习形成的，是条件反射。咀嚼、吞咽食物引起胃液分泌（A错）、异物接触眼球引起眼睑闭合（B错）、叩击股四头肌腱引起小腿前伸（C错）及强光刺激视网膜引起瞳孔缩小（D错），这些反射活动均为与生俱来的，为非条件反射。